葡萄胎经诊断明确后，应首选的治疗措施是
A. 先止血再清宫
B. 服补益肝肾中药
C. 行清宫术并送病检
D. 行全子宫切除术
E. 服活血化瘀中药

正确答案：C。行清宫术并送病检

解析：葡萄胎随时有大出血可能，且葡萄胎虽是良性疾患，但仍有潜在的恶性变。15%～20%的葡萄胎有恶性变的可能。同时清宫能够预防感染，减少出血。因此葡萄胎一经明确诊断后，应及时清宫并送病检（BE错，C对）；葡萄胎清宫手术本身就容易出现大出血的问题，如果出现了大出血的情况，需要及时的进行输血治疗（A错）；40岁以上的妇女患葡萄胎后发生恶变者较年轻妇女高4～6倍，故对于40岁以上、有高危因素（血β-HCG>100000U/L、子宫明显大于停经月份、卵巢黄素化囊肿直径>6cm、年龄>40岁、重复葡萄胎等）、无生育要求者才需要行全子宫切除术（D错）。